已知某常规药治疗冠心病的有效率为70％。根据纳入标准和排除标准选取300例冠心病患者，采用某新药进行治疗，结果显示240例患者有效。欲比较新药的疗效是否好于常规药，宜采用
A. 样本率与总体率比较的Z检验
B. 两样本率比较的Z检验
C. 两样本均数的t检验
D. 配对设计四格表资料的χ2检验
E. 成组设计四格表资料的χ2检验

正确答案：A。样本率与总体率比较的Z检验